检测化学毒物的生殖细胞染色体畸变作用选用
A. 微核试验
B. 显性致死试验
C. 细菌回复突变试验
D. 骨髓染色体畸变试验
E. 程序外DNA合成试验

正确答案：B。显性致死试验